下列属于青少年健康监测身体素质指标的是
A. 体重
B. 上臂围
C. 肺活量
D. 血压
E. 引体向上

正确答案：E。引体向上